流脑脑膜炎型患者出现昏迷，潮式呼吸和瞳孔不等大时，最主要的抢救措施为
A. 肌注苯巴比妥
B. 20%甘露醇静脉快速输入
C. 注射消旋山莨菪碱
D. 立即气管切开
E. 使用人工呼吸机

正确答案：B。20%甘露醇静脉快速输入